既能治疗肠腑病，又能治疗妇科病的腧穴是
A. 归来
B. 梁门
C. 丰隆
D. 天枢
E. 内庭

正确答案：D。天枢

解析：天枢穴既能治疗肠腑病，又能治疗妇科病（D对）。归来主治①小腹痛，疝气；②月经不调、带下、阴挺等妇科疾患（A错）。梁门“主治纳少、胃痛、呕吐等胃疾（B错 ）。丰隆主治①头痛，眩晕；②癫狂；③咳嗽痰多等痰饮病症；④下肢痿痹；⑤腹胀，便秘（C错）。内庭主治①齿痛、咽喉肿痛、鼻衄等五官热性病症；②热病；③吐酸、腹泻、痢疾、便秘等肠胃病症；④足背肿痛，跖趾关节痛（E错 ）。